肝硬化消化道出血，伴高血压冠心病患者，下列止血措施中最不恰当的是
A. 三腔二囊管压迫
B. 去甲肾上腺素胃管滴注
C. 垂体后叶素静脉滴注
D. 6-氨基已酸静脉滴注
E. 冰生理盐水洗胃

正确答案：C。垂体后叶素静脉滴注

解析：对肝硬化消化道出血伴高血压冠心病患者，应及时进行止血治疗。垂体后叶素（C错，为本题正确答案）禁用于高血压、冠状动脉粥样硬化性心脏病、心力衰竭患者和孕妇。而三腔二囊管压迫（A对）、去甲肾上腺素胃管滴注（B对）、6-氨基已酸静脉滴注（D对）、冰生理盐水洗胃（E对）均为高血压冠心病患者肝硬化消化道出血的止血措施。